属于配伍禁忌的是
A. 人参与莱菔子
B. 人参与五倍子
C. 人参与藜芦
D. 人参与海藻
E. 人参与大戟

正确答案：C。人参与藜芦

解析：本草明言十八反，半蒌贝蔹及攻乌，藻戟遂芫俱战草，诸参辛芍叛藜芦。人参与藜芦属于配伍禁忌（C对）。